发病率指的是
A. 患龋病人数/受检人数*100%
B. 患龋病牙数/受检人数x100%
C. 发生新龋的人数/受检人数x100%
D. 发生新龋的牙数/受检人数x100%
E. 发生新龋的牙数/受检牙数x100%

正确答案：C。发生新龋的人数/受检人数x100%

解析：本题考查评价龋病的常用指数。龋病发病率通常是指至少在一年时间内，某人群新发生龋病的频率。与患龋率不同的是仅指在这个特定时期内，新龋发生的频率。计算公式如下：龋病发病率=发生新龋的人数/受检人数x100%（C对）。患龋病人数/受检人数*100%（A错）为患病率。